下列叙述正确的是
A. 辅助病因不属于流行病学研究范畴
B. 只要致病的生物因子存在，疾病一定发生
C. 所有疾病都有明确的必要病因
D. 必要病因是组成各种充分病因的不可缺少的部分
E. 必要病因是疾病唯一病因

正确答案：D。必要病因是组成各种充分病因的不可缺少的部分